电镜观察，釉柱是由何种形状的晶体所组成
A. 正方形晶体
B. 长方形晶体
C. 圆柱形晶体
D. 扁六棱形晶体
E. 鱼鳞形晶体

正确答案：D。扁六棱形晶体

解析：电镜观察可见釉柱有一定排列方向的扁六棱柱形晶体所组成。掌握“牙釉质”知识点。